下列各项中错误的是
A. 人群对HDV和HEV普遍易感
B. 人感染HDV和HEV均不产生中和抗体
C. 接种乙肝疫苗可预防HDV感染
D. HCV传播途径以医源性传播为主
E. HEV有明显的季节性

正确答案：B。人感染HDV和HEV均不产生中和抗体